下列关于利福平的不良反应最恰当的选项是
A. 胃肠道反应
B. 肝脏毒性
C. 流感综合征
D. 出现皮疹、药热
E. 以上均对

正确答案：E。以上均对

解析：利福平的不良反应：①胃肠道反应：常见恶心、呕吐、腹痛、腹泻，一般不严重。②肝脏毒性：长期大量使用利福平可出现黄疸、肝肿大、肝功能减退等症状，严重时可致死亡。③流感综合征：大剂量间隔使用时可诱发发热、寒战、头痛、肌肉酸痛等类似感冒的症状。④其他：个别患者出现皮疹、药热等重症反应。偶见疲乏，嗜睡、头昏和运动失调等。掌握“异烟肼、利福平及乙胺丁醇”知识点。